对铜绿假单胞菌有效的抗生素是
A. 大观霉素
B. 庆大霉素
C. 氯霉素
D. 土霉素
E. 米诺环素

正确答案：B。庆大霉素

解析：本题考查庆大霉素。庆大霉素（B对）属于氨基糖苷类，可用于铜绿假单胞菌所致的严重感染。大观霉素（A错）用于淋病奈瑟菌所致的尿道炎、前列腺炎、宫颈阴道炎和直肠感染。氯霉素（C错）主要对伤寒沙门菌敏感。土霉素（D错）和米诺环素（E错）属于四环素类，抗菌谱广，对阳性菌的抑制作用强于阴性菌。